性凉，既收涩敛疮，又生肌止血的药是
A. 琥珀
B. 乳香
C. 儿茶
D. 血竭
E. 自然铜

正确答案：C。儿茶